“泰诺”属于
A. 药品通用名
B. 化学名
C. 拉丁名
D. 商品名
E. 俗名

正确答案：D。商品名

解析：本题考查药物的名称。“泰诺”属于商品名（D对）。“泰诺”是某制药公司生产的一种复方制剂感冒药，是该药的品牌名。药品通用名（A错）也称为国际非专利药品名称（INN），通常是指有活性的药物物质，而不是最终的药品，因此是药学研究人员和医务人员使用的共同名称。药物的化学名（B错）是根据药品的化学成分确定的化学学术名称。拉丁名（C错）是生药在国际上的通用名称。俗名（E错）是对药品非正式的名称，如“蒙汗药”就是三唑仑的俗称。